具有安神功能的藏药是
A. 洁白丸
B. 大月晶丸
C. 八味沉香散
D. 仁青芒觉
E. 仁青常觉

正确答案：C。八味沉香散

解析：本题考查的是八味沉香散的功能。具有安神功能的藏药是八味沉香散（C对）。八味沉香散的功能与主治：清心热，养心，安神，开窍。用于热病攻心，神昏谵语；冠心病，心绞痛。洁白丸（A错）的功能与主治：健脾和胃，止痛止吐，分清泌浊。用于胸腹胀满，胃脘疼痛，消化不良，呕吐泄泻，小便不利。大月晶丸（B错）的功能与主治：消炎解毒，和胃止酸，消食化痞。仁青芒觉（D错）的功能与主治：清热解毒，益肝养胃，明目醒神，愈疮，滋补强身。用于自然毒、食物毒、配制毒等各种中毒症；“培根木布”，消化道溃疡，急慢性胃肠炎，萎缩性胃炎，腹水，麻风病等。仁青常觉（E错）的功能与主治：清热解毒，调和滋补。用于“隆、赤巴、培根”各病，陈旧性胃肠炎、溃疡，“木布”病，萎缩性胃炎，各种中毒症；梅毒，麻风，陈旧热病，炭疽，疖痛，干黄水，化脓等。